一个病人思维清晰，智能相对良好，但有近事记忆障碍和言谈虚构倾向，最可能的综合征是
A. 谵妄综合征
B. 慢性脑病综合征
C. 急性脑病综合征
D. 痴呆综合征
E. 遗忘综合征

正确答案：E。遗忘综合征

解析：患者思维清晰，智能相对良好，以近事记忆障碍和言谈虚构为主要表现（E对）。谵妄综合征（急性脑病综合症）以意识障碍为主要特征，而本例患者思维清晰（无意识障碍），故不考虑（AC错）。痴呆以智能减退为主要特征，而本例患者智能相对良好，故不考虑（D错）。